T细胞发育、分化、成熟的场所是
A. 骨髓
B. 淋巴结
C. 胸腺
D. 外周免疫器官
E. 脾

正确答案：C。胸腺

解析：本题考查中枢和外周免疫器官。胸腺（C对）是T细胞分化、发育、成熟的主要场所。